诊断脊髓损伤最有价值的检查是
A. MRI
B. ECT
C. X线片
D. CT
E. B超

正确答案：A。MRI

解析：诊断脊髓损伤最有价值的检查是MRI（A对），MRI不仅可了解脊髓受压程度，还可观察脊髓信号强度、脊髓信号改变的范围和脊髓萎缩情况。ECT（B错）可用于全身血管检查。X线片（C错）和CT（D错）检查均为检查骨骼完整性连续性的优选检查。B超（E错）常用于检查脏器、组织等情况，不用于骨骼及运动系统。